关于情绪与情感的特点下列说法正确的是
A. 情绪较为稳定
B. 情感反映较持久
C. 情绪反应较深沉
D. 情感与生理性需要有关
E. 情感是人和动物共有的

正确答案：B。情感反映较持久

解析：情绪和情感统称为感情，它既包括感情发生的过程，也包括由此产生的各种体验，因而用单一的感情概念难以全面表达这种心理现象的全部特征。情绪和情感是彼此依存、相互交融的，稳定的情感是在情绪的基础上发展起来的，同时又通过情绪反应得以表达：情绪的变化往往反映情感的深度，在情绪发生的过程中，常常蕴涵着情感。情绪和情感的区别在于：情绪主要指感情过程，情绪的概念可用于动物和人（E错），与生理性需要有关（D错），而情感是人才有的高级心理现象，集中表达感情的体验和感受，具有稳定的、深刻的社会意义，反映较为深沉、持久（B对C错）：情绪是和有机体的生理需要能否得到满足相联系的体验，而情感是指人在社会历史发展过程中产生的、与社会需要相联系的体验：情绪带有情境性，变化快，而情感是对事物的稳定态度，受情境影响小：情绪往往带有冲动性（A错），情感冲动性较少。